代谢性碱中毒血气分析参数的变化是
A. 血浆HCO₃⁻浓度升高
B. pH增高
C. SB、AB、BB均升高，AB>SB,BE正值增大
D. PaCO₂升高
E. 以上都是

正确答案：E。以上都是

解析：代谢性碱中毒使细胞外液碱增多和（或）H+丢失引起pH增高（B对），由于H+浓度降低，呼吸中枢受抑制，呼吸变浅变慢，PaCO₂升高（D对），血浆HCO₃ ⁻浓度升高（A对），因此SB、AB、BB均升高，AB>SB,BE正值增大（C对，故E为本题正确答案）。